为了解某市居民慢性病患病情况以便制定相应的防治策略和措施，计划开展一项流行病学调查，要拟定一个调查方案，应该选用
A. 60岁以上的人群进行调查
B. 40岁以上的人群进行调查
C. 全人群进行普查
D. 抽样调查
E. 调查历年死因报告了解当地主要死因

正确答案：D。抽样调查